2002年12月广西某地山区一辆满载数吨剧毒化学品砒霜的卡车翻落在深山峡谷中，大部分毒物抛撒到谷底的河流里，而下游15km的居民则以这条河的水作为饮用水水源。当得知这一事故的报告后除向有关部门领导汇报外，你作为一个专业技术人员从保护人民健康的角度出发，首先应
A. 立即赶赴现场了解具体情况
B. 查阅有关资料
C. 立即通知下游居民暂停饮用河水
D. 提出对受污染河水处理的具体措施
E. 关注污染可能带来的生态破坏

正确答案：C。立即通知下游居民暂停饮用河水

解析：本题考查事故的处理。由于这辆卡车满载数吨剧毒化学品砒霜，而且大部分毒物抛撒到谷底的河流里，下游15km的居民则以这条河的水作为饮用水水源，因此，为了保护人民健康，首先应该立即通知下游居民暂停饮用河水（C对ABDE错）。